小儿消化系统的生理特点下列哪项是错误的
A. 新生儿幽门括约肌发育较好
B. 婴儿肝细胞再生能力强，不易发生肝硬化
C. 小儿肠管相对较成人长，且固定差，易发生肠套叠和肠扭转
D. 小儿肠道的屏障功能差
E. 婴儿时期消化酶的分泌不易受外界因素的影响

正确答案：E。婴儿时期消化酶的分泌不易受外界因素的影响

解析：新生儿食管下部括约肌松弛，幽门括约肌较发达（A对）；婴儿肝结缔组织发育较差，肝细胞再生能力强，不易发生肝硬化（B对）；小儿肠黏膜肌层发育差，肠系膜柔软而长，结肠无明显结肠带与脂肪垂，升结肠与后壁固定差，易发生肠扭转和肠套叠（C对）；小儿肠道肠壁薄，故通透性高，屏障功能差（D对）；婴儿时期消化酶的分泌易受炎热天气和各种疾病的影响而被抑制，易发生消化不良（E错，为本题正确答案）。